可用寒因寒用法治疗的证候是
A. 实寒证
B. 虚寒证
C. 真热假寒证
D. 真寒假热证
E. 寒热错杂证

正确答案：C。真热假寒证

解析：寒因寒用 即以寒治寒，是指用寒性药物来治疗具有假寒征象的病证。它适用于阳盛格阴的真热假寒证。真热假寒，即阳盛格阴导致既有壮热、面红、烦躁等热盛于内，又有四肢厥冷的假寒之象，应选用寒凉药物来治疗（C对）。阴胜则寒的实寒证通常用温热药来治疗，即寒者热之（A错）。阳偏衰产生的是“阳虚则寒”的虚寒证，治疗当扶阳抑阴，《内经》称之为“阴病治阳”（B错）。由阴盛格阳导致的真寒假热应用热性药物来治疗，即热因热用（D错）。